粘接剂与被粘体的分子间发生化学反应的机制称为
A. 化学结合
B. 氢键结合
C. 相互混合
D. 分子间结合
E. 嵌合

正确答案：A。化学结合

解析：化学结合：粘接剂与被粘体的分子间发生化学反应而形成的结合。掌握“修复材料、金瓷结合及树脂粘结机制”知识点。